皮敏消胶囊适用于
A. 荨麻疹
B. 痤疮
C. 急性湿疹
D. 脚癣
E. 手足皲裂

正确答案：A。荨麻疹